低血糖症是指血浆葡萄糖浓度低于
A. 2.0mmol/L
B. 3.3mmol/L
C. 2.8mmol/L
D. 3.0mmol/L
E. 4.0mmol/L

正确答案：C。2.8mmol/L

解析：一般引起低血糖症状的血浆葡萄糖阈值为2.8～3.9mmol/L，但单凭血糖（除非＜2.5mmol/L）不能诊断低血糖症，其诊断依据是Whipple三联征：①低血糖症状；②症状发作时血糖低于正常（＜2.8mmol/L，该数据在三版八年制教材为3.0mmol/L）；③供糖后与低血糖相关的症状迅速缓解（C对）。